在肿块触诊中，不属癌性肿块特性的是
A. 高低不平
B. 坚硬如石
C. 推之不能移动
D. 表面与皮肤粘连
E. 表面光滑

正确答案：E。表面光滑

解析：本题考查良、恶性肿瘤的鉴别。良性肿物一般表面光滑，而恶性的癌性肿物则通常可触及表面凹凸不平（E对）。癌性肿块符合中医的岩的特点：肿块坚硬，高低不平，皮色不变，推之不移，溃烂后如翻花石榴，色紫恶臭，疼痛剧烈（ABCD错）。